女性，30岁。3个月来工作较累，近3年来出现兴趣缺乏，易疲劳，言语少，动作迟缓，自觉脑子笨，没有以前聪明，早醒，食欲减退，腹胀，便秘，全身酸痛，有时感心悸，气急。总觉自己患了不治之症，给家庭带来许多麻烦。该病人最可能的诊断是
A. 焦虑症
B. 神经衰弱
C. 疑病症
D. 抑郁症
E. 心身疾病

正确答案：D。抑郁症

解析：该病人近3年来出现兴趣缺乏、易疲劳、言语少，动作迟缓，自觉脑子笨、没以前聪明（自我评价低），早醒，食欲减退，总觉患了不治之症，给家庭带来许多麻烦（自责自罪）为抑郁发作的表现（D对）。焦虑症以焦虑为主要临床表现，患者常常有不明原因的提心吊胆、紧张不安，无情感低落（忧愁、苦闷、唉声叹气、暗自落泪，严重时可因悲观绝望而出现自杀企图及行为等）的表现，与本例不符（A错）。疑病症病前常有过分关注自身健康，可表现为全身不适，疼痛，常四处求医但查无实据，且无情感低落（忧愁、苦闷、唉声叹气、暗自落泪）表现，与本例不符（C错）。